女，48岁。接触性出血3个月。妇科检查：宫颈呈糜烂状，宫体大小正常，活动好，双侧附件区无异常。三合诊（-）。阴道镜下活检病理示鳞状细胞癌，间质浸润深度6mm。该患者的临床分期应是
A. 宫颈原位癌
B. 宫颈癌IA2期
C. 宫颈癌IB2期
D. 宫颈癌IA1期
E. 宫颈癌IB1期

正确答案：E。宫颈癌IB1期

解析：该患者中年女性，接触性出血3个月（宫颈癌常表现为接触性出血，即性生活或妇科检查后阴道流血），宫颈呈糜烂状，宫体大小正常，活动好，双侧附件区无异常，三合诊（﹣），阴道镜下活检病理示鳞状细胞癌，间质浸润深度6mm（ⅠB1期：临床癌灶局限于子宫颈，间质内浸润深度＞5mm，癌灶≤4cm。ⅠB2期癌灶＞4cm，患者宫颈呈糜烂状，应视为其≤4cm），诊断为子宫颈癌，临床分期为ⅠB1期（E对）。子宫颈癌临床分期：（1）Ⅰ期 肿瘤局限在子宫颈（扩展至宫体将被忽略）。ⅠA 镜下浸润癌（所有肉眼可见的病灶，包括表浅浸润，均为ⅠB期），间质浸润深度＜5mm，宽度≤7mm；ⅠA1（D错） 间质浸润深度≤3mm，宽度≤7mm；ⅠA2（B错）间质浸润深度＞3mm且＜5mm，宽度≤7mm。ⅠB期临床癌灶局限于子宫颈，或者镜下病灶＞ⅠA；ⅠB1（E对）临床癌灶≤4cm；ⅠB2（C错） 临床癌灶＞4cm。（2）Ⅱ期 肿瘤超越子宫，但未达骨盆壁或未达阴道下1/3。（3）Ⅲ期 肿瘤已扩展到骨盆壁，在直肠指诊时，在肿瘤和盆壁之间无间隙。肿瘤累及阴道下1/3，由肿瘤引起的肾盂积水或肾无功能的所有病例，除非已经知道由其他原因所引起。（4）Ⅳ期 肿瘤超出了真骨盆范围，或侵犯膀胱和（或）直肠黏膜。宫颈原位癌（A错）是指病变细胞占据上皮全层，但未突破基底膜。